关于酶原激活的生理意义描述正确的是
A. 保护细胞的蛋白酶不被蛋白质水解破坏
B. 保护非细胞本身的蛋白质不被水解破坏
C. 保证合成的酶在特定环境中发挥生理作用
D. 保证合成的蛋白质在特定部位发挥生理作用
E. 以上均正确

正确答案：C。保证合成的酶在特定环境中发挥生理作用

解析：酶原激活具有重要的生理意义。一方面保护细胞本身的蛋白质不受蛋白酶的水解破坏，另一方面保证合成的酶在特定部位和环境中发挥生理作用。掌握“酶活性调节（抑制与激活）”知识点。